常用的局麻药物中，属于酯类的是
A. 丁卡因
B. 利多卡因
C. 布比卡因
D. 阿替卡因
E. 甲哌卡因

正确答案：A。丁卡因

解析：本题考查颌面部常用局部麻醉药物。局麻药物的种类很多，按其化学结构可分为酯类和酰胺类。国内常用的酯类局麻药物有普鲁卡因、丁卡因（A对），酰胺类的有利多卡因（B错）、布比卡因（C错）等。